腮腺的导管开口于
A. 上颌第1磨牙牙冠相对应的颊黏膜上
B. 下颌第1磨牙牙冠相对应的颊黏膜上
C. 上颌第2磨牙牙冠相对应的颊黏膜上
D. 下颌第2磨牙牙冠相对应的颊黏膜上
E. 上颌第3磨牙牙冠相对应的颊黏膜上

正确答案：C。上颌第2磨牙牙冠相对应的颊黏膜上

解析：腮腺导管开口于上颌(BD错)第2磨牙(ABE错)牙冠所对的颊粘膜的腮腺管乳头上(C对)。